瓜蒂研末吹鼻，可
A. 通鼻窍
B. 开心窍
C. 去湿热
D. 止痹痛
E. 止牙痛

正确答案：C。去湿热

解析：本题考查的是瓜蒂的功效。瓜蒂研末吹鼻，可去湿热（C对）。瓜蒂：【功效】内服涌吐热痰、宿食；外用研末吹鼻，引去湿热。辛夷：【功效】散风寒，通鼻窍（A错）。石菖蒲：【功效】开窍（B错）宁神，化湿和胃。露蜂房：【性能特点】本品甘解性平，质轻有毒，入肝、胃经。善攻毒杀虫，治疮痈、瘰疬、顽癣常用；能祛风止痛，治牙痛（E错）、风湿痹痛（D错）可投。【功效】攻毒杀虫，祛风止痛。